某男，45岁。平日喜食辛辣，近日突发头痛眩晕，目赤耳鸣，口燥咽干，大便燥结。证属胃肠积热，治当清热解毒，泻火通便，宜选用的成药是
A. 芩连片
B. 黛蛤散
C. 西黄丸
D. 清开灵片
E. 牛黄至宝丸

正确答案：E。牛黄至宝丸

解析：本题考查的是牛黄至宝丸的主治。平日喜食辛辣，近日突发头痛眩晕，目赤耳鸣，口燥咽干，大便燥结。证属胃肠积热，治当清热解毒，泻火通便，宜选用的成药是牛黄至宝丸（E对）。牛黄至宝丸：【主治】胃肠积热所致的头痛眩晕、目赤耳鸣、口燥咽干、大便燥结。芩连片（A错）：【主治】脏腑蕴热，头痛目赤，口鼻生疮，热痢腹痛，湿热带下，疮疖肿痛。黛蛤散（B错）：【主治】肝火犯肺所致的头晕耳鸣、咳嗽吐衄、痰多黄稠、咽膈不利、口渴心烦。西黄丸（C错）：【主治】热毒壅结所致的痈疽疔毒、瘰疬、流注、癌肿。清开灵片（D错）：【主治】外感风热时毒、火毒内盛所致高热不退、烦躁不安、咽喉肿痛、舌质红绛、苔黄、脉数；上呼吸道感染、病毒性感冒、急性化脓性扁桃体炎、急性咽炎、急性气管炎、高热等病症属上述证候者。